界嵴分隔
A. 左心室与右心室
B. 左心房与右心房
C. 右心室的流入道与流出道
D. 主动脉前庭与左心室
E. 腔静脉窦与固有心房

正确答案：E。腔静脉窦与固有心房

解析：腔静脉窦与固有心房（E对）由界嵴及界沟分隔。分为前部的固有心房和后部的腔静脉窦，其中界嵴为两者在腔面的分界，界沟为两者在心表面的分界。